百会穴的具体位置在
A. 头正中线前发际7寸
B. 头正中线后发际6寸
C. 头正中线前发际5寸
D. 头顶旋毛中
E. 两耳连线上

正确答案：C。头正中线前发际5寸

解析：百会穴，在头部，前发迹正中直上5寸（C对），后发迹上7寸，或取两耳直上连线中点。